颗粒的弹性复原率较高时，易发生
A. 裂片（顶裂）
B. 松片
C. 黏冲
D. 片重差异超限
E. 崩解迟缓

正确答案：A。裂片（顶裂）

解析：本题考查片剂制备中的常见问题及原因。弹性复原率较高时，物料的塑形越差，结合力弱，从而导致裂片（A对）；松片（B错）原因有药物粉碎细度不够、含水量少等；黏冲（C错）原因有颗粒不够干燥、润滑剂选用不当、冲头表面锈蚀等；片重差异超限（D错）产生的原因为颗粒流动性不好、颗粒内的细粉太多或颗粒的大小相差悬殊等；崩解迟缓（E错）原因可能为颗粒中疏水物质含量过多。